林某，女性，45岁，大学某研究所研究员，近年工作繁重，近2个月，林某常有莫名其妙的焦虑和不安，注意力不集中，食欲下降，白天头痛、烦闷、全身乏力，晚上失眠心悸，做了2次比较全面的物理检查和生化检查，均没有阳性结果，林某所处的健康状况最有可能的是
A. 器质性疾病状态
B. 基本健康状态
C. 亚临床状态
D. 第三状态
E. 无症状疾病状态

正确答案：D。第三状态